由消化道摄入金属汞后
A. 吸收引起急性汞中毒
B. 吸收引起中毒性肾炎
C. 吸收引起中毒性肝病
D. 刺激胃肠黏膜引起腐蚀性胃肠炎
E. 几乎全由肠道排出，对人体无害

正确答案：E。几乎全由肠道排出，对人体无害